小儿营养不良是指体重低于正常均值的
A. 60%
B. 70%
C. 85%
D. 95%
E. 90%

正确答案：C。85%

解析：体重可以反映小儿体格生长状况和衡量小儿营养状况，其中体重低于正常均值的85%者为营养不良（C对）。